患者，女，58岁。因暑天乘凉饮冷，出现恶寒发热，头痛脘痞，恶心，呕吐频作，食少泄泻，舌苔腻脉濡。治疗应首选
A. 黄连
B. 藿香
C. 生姜
D. 竹茹
E. 紫苏

正确答案：B。藿香

解析：患者暑天乘凉饮冷，出现恶寒发热，头痛脘痞，恶心，食少泄泻，舌苔腻脉濡，属于寒湿闭暑证，治疗当发表解暑，化湿和中；患者又兼呕吐，当和中止呕；应首选芳香化湿，和中止呕，发表解暑的藿香（B对）。黄连（A错）的功效是清热燥湿，泻火解毒。生姜（C错）的功效是解表散寒，温中止呕，化痰止咳。竹茹（D错）的功效是清热化痰，除烦止呕。紫苏（E错）的功效是解表散寒，行气和胃。